男性，54岁，经社区健康普查确诊高血压病2年，生活规律，饮食清淡，偶尔吸烟，曾服用降压药1年，血压恢复正常后自行停药。因近日血压升高、头晕而就诊。导致其血压波动的最可能的因素是
A. 紧张刺激
B. 吸烟
C. 高钠盐饮食
D. 从医行为不良
E. 缺少锻炼

正确答案：D。从医行为不良